急性根尖周炎最有效的应急处理是
A. 服用消炎镇痛药
B. 安抚镇痛
C. 患牙调（牙合）
D. 开髓、根管引流
E. 局麻镇痛

正确答案：D。开髓、根管引流

解析：应急处理为开髓引流。目的：引流炎症渗出物，降低髓腔高压，以缓解剧痛。是急性根尖周炎最有效的应急处理。掌握“急性根尖周炎”知识点。